患者，男性，56岁。有急性心肌梗死病史，经治疗好转后，停药月余，昨夜突发剧咳而憋酲，不能平卧，咳粉红色泡沫样痰，烦躁不安，心率130次/分，血压160/90mmHg，两肺有小水泡音。诊断为急性左心衰竭，心源性哮喘，问用哪种药物治疗最适宜
A. 阿托品
B. 吗啡
C. 去甲肾上腺素
D. 卡托普利
E. 纳洛酮

正确答案：B。吗啡